8个月男婴Ⅱ°烧伤时每1％面积、公斤体重额外丢失补液量为
A. 1.0ml
B. 1.5ml
C. 2.0ml
D. 2.5ml
E. 3.0ml

正确答案：C。2.0ml

解析：根据八版外科学补液方案，伤后第一个24小时：成人每1%Ⅱ°、Ⅲ°烧伤面积每公斤体重补充胶体液0.5ml和电解质液1ml，广泛深度烧伤者与小儿烧伤其比例可改为1：1，即成人、广泛深度烧伤者与小儿烧伤在伤后的24小时内，每1%Ⅱ°、Ⅲ°面积每公斤体重额外丢失补液量均为1.5ml，但在实际临床应用中普遍认为此观点有误。七版外科学P183和七版黄家驷外科学P90都明确说明小儿烧伤后，在第一个24小时内，每1%Ⅱ°、Ⅲ°烧伤面积每公斤体重额外丢失补液量为2.0ml（C对）。